男，40岁。发作性心悸、头痛、大汗，发作时血压230/130mmHg，平素血压不高。对诊断最有帮助的是发作时测定尿
A. 儿茶酚胺
B. 蛋白
C. 钾、钠、氯
D. 钙、磷
E. 游离皮质醇

正确答案：A。儿茶酚胺

解析：中年男性患者，发作性心悸，头痛，大汗，发作时血压230/130mmHg，平素血压不高，最有可能的诊断是嗜铬细胞瘤。嗜铬细胞瘤（PHEO）起源于肾上腺髓质、交感神经节或其他部位的嗜铬组织，这种瘤持续或间断地释放大量儿茶酚胺，引起持续性或阵发性高血压和多个器官功能及代谢紊乱（P710）。因此，对诊断最有帮助的是发作时测定尿儿茶酚胺（A对）。尿蛋白（B错）测定主要用于肾病综合征及肾小球肾炎的诊断与鉴别诊断。尿钾、钠、氯（C错）的异常可见于水、电解质平衡紊乱与肾衰竭等，无特异性。尿钙、磷（D错）测定主要用于甲状旁腺功能亢进症的诊断。游离皮质醇（E错）主要用于库欣综合征的诊断。